α-葡萄糖苷酶抑制药的作用机制是
A. 刺激胰岛细胞释放胰岛素
B. 促进肝糖原合成
C. 增加肌肉组织中糖的无氧酵解
D. 增加肌肉组织中糖的有氧氧化
E. 与碳水化合物竞争水解碳水化合物的酶

正确答案：E。与碳水化合物竞争水解碳水化合物的酶

解析：α-葡萄糖肝酶抑制药是一类新型口服降糖药，降糖机制为，口服后在小肠黏膜刷状缘竞争性抑制葡萄糖苷酶和蔗糖酶（E对），减慢多糖、蔗糖生成葡萄糖的速度并延缓葡萄糖的吸收，降低血糖浓度。磺酰脲类降糖药与胰岛B细胞膜上磺酰脲受体结合，刺激胰岛B细胞释放胰岛素（A错），降低血清糖原水平，增强胰岛素与靶组织的结合能力。胰岛素主要促进肝脏、脂肪、肌肉等靶组织糖原和脂肪的储存，促进肝糖原的合成和贮存（B错），加速葡萄糖的氧化和酵解（CD错），并抑制糖原分解和异生而降低血糖。